用于挥发油提取的常用方法是
A. 水蒸气蒸馏法
B. 吸附柱色谱法
C. 水煎煮法
D. UV光谱法
E. 气相色谱-质谱联用法

正确答案：A。水蒸气蒸馏法

解析：本题考查的是水蒸气蒸馏法。用于挥发油提取的常用方法是水蒸气蒸馏法（A对）。挥发油又称精油，是存在于植物中的一类具有挥发性、可随水蒸气蒸馏且与水不相混溶的油状液体的总称。挥发油大多具有芳香气味，所以又称芳香油。吸附柱色谱法（B错）此法可用于分离各类型及不同存在形式的三萜化合物。煎煮法（C错）此法以水为提取溶剂，将中药粗粉加水加热煮沸提取，是最传统、经典的提取方法。此法简便易行，适用于大部分有效成分的提取，但是对含挥发性成分及加热易破坏的成分不宜使用。采用水煎煮法时，应注意易出现糊化现象，提取液中水溶性杂质较多，水煎液放置时间过长容易发生霉变等问题。紫外（UV）光谱（D错）的测定仅需要少量的纯样品，这对于中药化学成分的研究是非常有利的。一般来说，UV光谱主要提供化合物分子中共轭体系的结构信息，可据此判断共轭体系中取代基的种类、位置和数目。气相色谱是研究挥发油组成成分非常有效的方法，特别是应用制备型气相色谱-质谱联用（E错）技术，可成功地将挥发油中众多成分予以分离并同时进行鉴定。